痛风定胶囊善治痛风，其功能是
A. 活血通络，散风止痛
B. 养血舒筋，祛风除湿，补益肝肾
C. 祛风散寒，化痰除湿，活血止痛
D. 清热祛湿，活血通络定痛
E. 祛风除湿，通络止痛，补益肝肾

正确答案：D。清热祛湿，活血通络定痛

解析：本题考查的是痛风定胶囊的功能。痛风定胶囊善治痛风，其功能是清热祛湿，活血通络定痛（D对）。痛风定胶囊：【功能】清热祛湿，活血通络定痛。颈复康颗粒：【功能】活血通络，散风止痛（A错）。独活寄生合剂：【功能】养血舒筋，祛风除湿，补益肝肾（B错）。小活络丸：【功能】祛风散寒，化痰除湿，活血止痛（C错）。天麻丸：【功能】祛风除湿，通络止痛，补益肝肾（E错）。